牙根发育过程中，由哪几部分构成根端复合体
A. 成釉器、牙乳头、牙囊
B. 上皮根鞘、成釉细胞、星网状层
C. 缩余釉上皮、上皮隔、牙乳头
D. 成牙骨质细胞、成纤维细胞、成牙本质细胞
E. 上皮根鞘、牙乳头、牙囊

正确答案：E。上皮根鞘、牙乳头、牙囊

解析：牙根发育过程中，发育中的牙根包括上皮根鞘、牙乳头和牙囊，此三者相互作用，在牙齿发育的早期作为一个整体性的功能复合物，被称为发育期根端复合体。掌握“牙体、牙周组织的形成”知识点。